刺激胰岛B细胞分泌胰岛素的药物是
A. 阿卡波糖
B. 二甲双胍
C. 甲巯咪唑
D. 硫唑嘌呤
E. 格列本脲

正确答案：E。格列本脲

解析：本题考查格列本脲的作用机制。格列本脲（E对）是磺酰脲类降糖药，能够刺激胰岛B细胞释放胰岛素，抑制肝糖原分解和糖异生作用，降低血糖。二甲双胍（B错）为双胍类口服降糖药，通过促进组织对葡萄糖的摄取和利用，增加无氧酵解，抑制葡萄糖在肠道的吸收，抑制肝糖原异生，以及拮抗胰高血糖素，提高胰岛。甲巯咪唑（C错）属于硫脲类抗甲状腺药。巯唑嘌呤（D错）作用机制与巯嘌呤类似，可抑制DNA合成，为免疫抑制药。